关于过期流产的处理，下述何项是错误的
A. 刮宫前先作凝血功能检查，防术时因凝血障碍而大出血
B. 刮宫前必须先用雌激素以提高子宫肌肉对催产素的敏感性
C. 刮宫前作好备血，输液准备
D. 力争做到一次刮净，以防因不全而出血
E. 过期流产胎盘机化，术中谨防穿孔

正确答案：D。力争做到一次刮净，以防因不全而出血

解析：因胚胎组织机化与宫壁粘连，刮宫时有可能遇到困难，而且此时子宫肌纤维可发生变性，失去弹性，刮宫时出血可能较多并有子宫穿孔的危险。故过期流产的刮宫术必须慎重，如一次不能刮净应于5～7天后再次刮宫。掌握“自然流产”知识点。